降结肠癌最常见的临床表现是
A. 贫血粘液水肿
B. 恶心呕吐
C. 大量频繁腹泻
D. 排便习惯改变
E. 左腹部触及肿块

正确答案：D。排便习惯改变

解析：降结肠的生理功能主要是吸收水分及贮存大便，降结肠癌多为浸润型，其最常见的临床表现是排便习惯改变（D对），如便频、便秘等。随着病情进展，病人可出现恶心、呕吐（B错）、大量频繁腹泻（C错），但其不是降结肠癌最常见的临床表现，且多数病人是便频，不是真正的腹泻。贫血、粘液水肿（A错）、腹部肿块（E错）是右侧结肠癌主要表现，故应排除。